DNA指导的RNA合成，称为
A. 复制
B. 转录
C. 编码
D. 逆转录
E. 翻译

正确答案：B。转录

解析：DNA指导的RNA合成，称为转录。掌握“RNA的生物合成”知识点。